真地吉他林是
A. 洋地黄毒苷-（D葡萄糖）
B. 苷元-（6-去氧糖）-（D-葡萄糖）
C. 苷元-（D-葡萄糖）
D. 美丽毒毛旋花子苷-（n葡萄糖）
E. 苷元-（D-葡萄糖）-（2，6-二去氧糖）

正确答案：B。苷元-（6-去氧糖）-（D-葡萄糖）